患者，男性，36岁，进食后突发上腹刀割样疼痛3小时。查体：腹肌紧张，全腹压痛、反跳痛，肝浊音界消失。血常规：白细胞及中性粒细胞升高。最可能的诊断是
A. 胃溃疡穿孔
B. 急性阑尾炎
C. 急性胰腺炎
D. 急性胆囊炎
E. 急性大叶性肺炎

正确答案：A。胃溃疡穿孔